超临界流体物质有
A. 石油醚
B. 乙醇
C. 液态二氧化碳
D. 氧气
E. 丙酮

正确答案：C。液态二氧化碳

解析：本题考查的是超临界流体萃取法。超临界流体物质有二氧化碳（C对）。超临界流体萃取法：是采用超临界流体为溶剂对中药材进行萃取的方法。已知可作为超临界流体的物质很多，如二氧化碳、一氧化二氮、六氟化硫、乙烷、庚烷、氨、二氯二氟甲烷等，其中以二氧化碳最为常用。乙醇（B错）、丙酮（E错）可作超临界流体萃取法的夹带剂。夹带剂作为亚临界组分，挥发度介于超临界流体与被萃取溶质之间，以液体形式和相对小的量加入超临界流体中。其作用在于：①改善或维持选择性。②提高难挥发溶质的溶解度。一般，具有很好溶解性能的溶剂，也往往是很好的夹带剂，如甲醇、乙醇、丙酮和乙腈等。石油醚（A错）为有机溶剂。氧气（D错）为氧化剂。